患者，女，58岁，下颌876|678缺失，牙槽嵴丰满，口内余牙情况良好，咬合关系正常，设计为黏膜支持式义齿的要点是
A. 减小基托范围
B. 减轻基牙（牙合）力
C. 减小支持组织承受的力
D. 增加牙尖高度
E. 使用耐磨性好的瓷牙

正确答案：C。减小支持组织承受的力

解析：因为患者双侧后牙缺失，承受力均由黏膜承担，所以在设计时要减少支持组织承受的力。掌握“局部义齿的设计”知识点。